增加小麦的出粉率，主要影响哪种营养素的营养价值
A. 矿物质
B. 脂肪
C. 蛋白质
D. B族维生素
E. 碳水化合物

正确答案：A。矿物质